对食品中生物、化学和物理因素所产生的不良健康影响进行定性分析属于
A. 风险预测
B. 危害识别
C. 暴露评估
D. 危害特征描述
E. 风险特征描述

正确答案：D。危害特征描述